牙周病患者在使用牙线前应首先进行
A. 刷牙
B. 漱口
C. 牙签去除菌斑
D. 龈上洁治和根面平整
E. 牙龈按摩

正确答案：D。龈上洁治和根面平整

解析：牙周病患者使用牙线之前，应首先进行龈上洁治和根面平整，如磨光存在邻面充填体悬突，使之与牙齿的解剖外形一致，以免钩住牙线使牙线磨损而容易拉断。掌握“菌斑控制及提高宿主抵抗力”知识点。